不是缺碘性地方性甲状腺肿的发病机制的是
A. 促甲状腺素分泌增加
B. 甲状腺素合成减少
C. 促使甲状腺增生肥大
D. 促甲状腺素分泌减少
E. 甲状腺胶质过量分泌

正确答案：D。促甲状腺素分泌减少

解析：本题考查地方性甲状腺肿的发病机制。地方性甲状腺肿是一种主要由于地区性环境缺碘引起的地方病。其发病机制是：碘是合成甲状腺激素的主要原料。当环境缺碘，机体摄入碘不足时，甲状腺激素合成下降（B对），可反馈性地促使垂体前叶分泌促甲状腺激素（A对）增加（D错，为本题正确答案），使甲状腺组织出现代偿性增生，腺体肿大（C对）。初期为弥漫性甲状腺肿，属代偿性的生理肿大，不伴有甲状腺功能异常。如及时补充碘，肿大的甲状腺可完全恢复正常。如进一步发展，酪氨酸碘化不足或碘化错位，便产生异常的甲状腺球蛋白，失去正常甲状腺激素作用，并且不易水解分泌而堆积在腺体滤泡中，致使滤泡肿大，胶质充盈（E对），呈胶质性甲状腺肿。一部分滤泡由于胶质不断蓄积而高度扩张，滤泡上皮细胞受压迫，出现局部纤维化，供血不足，细胞坏死，产生退行性变、囊性变及钙化等表现。上述过程循环变化，最终形成大小不等软硬不一的结节，即为结节性甲状腺肿，成为不可逆的器质性病变。